关于转基因食品理解错误的是
A. 转基因动植物产品是转基因食品
B. 转基因微生物产品是转基因食品
C. 转基因动植物直接加工品是转基因食品
D. 以转基因微生物为原料生产的食品不是转基因食品
E. 是指以利用基因工程技术改变基因组构成的动物、植物和微生物而生产的食品

正确答案：D。以转基因微生物为原料生产的食品不是转基因食品